下列各项，不符合古代医患关系特点的是
A. 直接性
B. 稳定性
C. 整体性
D. 主动性
E. 单一性

正确答案：E。单一性

解析：不符合古代医患关系特点的是单一性，医患关系特点的是直接性、稳定性、整体性、主动性、继承性（E错，为本题正确答案）。